我国对农业转基因生物安全评价的危险分级中，Ⅲ级是
A. 尚不存在危险
B. 具有低度危险
C. 具有中度危险
D. 具有高度危险
E. 具有极高度危险

正确答案：C。具有中度危险